下列有关工作有关疾病论述错误的是
A. 又称职业性多发病
B. 是由职业性有害因素所致的职业性疾患
C. 与职业性有害因素有直接因果关系
D. 职业性有害因素是造成该病的许多因素之一
E. 职业性有害因素促使该病的显露和加重

正确答案：C。与职业性有害因素有直接因果关系